麻杏石甘汤中，石膏和麻黄比例是
A. 9:1
B. 8:1
C. 4:1
D. 2:1
E. 1:1

正确答案：D。2:1

解析：麻黄杏仁甘草石膏汤麻黄四两，石膏半斤也就是八两，石膏和麻黄的比例是2：1（D对）。九一丹中石膏九钱，黄灵药一钱，石膏和黄灵药的比为9：1（A错）。肾气丸中干地黄八两，附子一两，干地黄和附子的比例是8:1（B错）。大黄牡丹汤大黄四两、牡丹皮一两，大黄和牡丹的用量比为4：1（C错）。桂枝汤桂枝三两，芍药三两，桂枝和芍药的用量比是1:1（E错）。